在下颌骨的外侧面可见
A. 颏结节
B. 下颌小舌
C. 下颌孔
D. 下颌隆突
E. 下颌舌骨线

正确答案：A。颏结节

解析：本题考查下颌骨及腭骨解剖特点。下颌体：外侧面中线处有正中联合；正中联合两旁有左右各一的颏结节（A对）；从颏结节向后上延至下颌支前缘的骨嵴，称为外斜线，有降下唇肌及降口角肌附着；在外斜线上方，下颌第二前磨牙的下方或第一、第二前磨牙之间的下方，下颌体上、下缘之间略偏上处有颏孔。其内侧面近中线处有两对突起，上颏棘和下颏棘；自下颏棘斜向后上与外斜线相应的骨嵴称为内斜线（下颌舌骨线）；内斜线上方，颏棘两侧有舌下腺窝；内斜线下方，近下颌体下缘有下颌下腺窝和二腹肌窝。